下列哪项不是地图舌的临床表现
A. 红色区可糜烂
B. 剥脱区微凹陷
C. 丝状乳头片状剥脱
D. 菌状乳头清晰可见
E. 舌背形成红色光滑区

正确答案：A。红色区可糜烂

解析：本题考查地图舌的临床表现。红色区不发生糜烂（A错，为本题的正确答案），无疼痛等不良临床表现。地图舌又称为地图样舌，是一种浅表性非感染性的舌部炎症。好发于舌背、舌尖、舌缘部。病损部位由周边区和中央区组成。中央区为丝状乳头片状剥脱（C对）所致，剥脱区微凹陷（B对），菌状乳头清晰可见（D对），黏膜充血发红，形成红色光滑区（E对）。